与腮腺分泌有关的神经为
A. 岩大神经
B. 眼神经
C. 鼓索
D. 岩小神经（节前纤维）
E. 无

正确答案：D。岩小神经（节前纤维）

解析：鼓室丛发出岩小神经（D对）至卵圆孔下方的耳神经节交换神经元，节后纤维经耳颞神经分布于腮腺。